不宜与川乌合用的中药有
A. 半夏
B. 瓜蒌
C. 川贝
D. 白蔹
E. 白薇

正确答案：A、B、C、D。半夏；瓜蒌；川贝；白蔹

解析：本题考查的是配伍禁忌。不宜与川乌合用的中药有半夏（A对）、瓜蒌（B对）川贝（C对）与白蔹（D对）。十八反列述了三组相反药，分别是：甘草反甘遂、京大戟、海藻、芫花；乌头（川乌、附子、草乌）反半夏、瓜蒌（全瓜蒌、瓜蒌皮、瓜蒌仁、天花粉）、贝母（川贝、浙贝）、白蔹、白及；藜芦反人参、南沙参、丹参、玄参、苦参、细辛、芍药（赤芍、白芍）。白薇（E错）与川乌不属于配伍禁忌。